肺癌空洞常发生于
A. 鳞状上皮癌
B. 腺癌
C. 大细胞未分化癌
D. 小细胞未分化癌
E. 细支气管-肺泡癌

正确答案：A。鳞状上皮癌

解析：肺癌空洞常发生于鳞状上皮癌，癌组织易变性、坏死，形成空洞或癌性肺脓肿（A对）。腺癌往往在胸部X线检查时被发现。表现为圆形或椭圆形肿块，一般生长较慢，但有时早期即发生血行转移（B错）。大细胞未分化癌X线片上可显示突入支气管腔内的肿块阴影、管壁不规则、增厚或管腔狭窄、阻塞。肿瘤侵犯邻近肺组织和转移到肺门纵隔淋巴结时，可见肺门区肿块，或纵隔阴影增宽，轮廓呈波浪形，肿块形态不规则，边缘不整齐，有时呈分叶状（C错）。小细胞肺癌的特点是：①肺门肿块大且明显②肺内“阻变”少而轻③转移征象出现早④对化疗，放疗反应敏感（D错）。细支气管-肺泡癌有结节型和弥漫型两种表现（E错）。